寒邪内阻腹痛的主要特点是
A. 腹痛急暴，得温痛减
B. 腹痛绵绵，时痛时止
C. 腹痛拒按，烦渴引饮
D. 腹部胀痛，攻窜不定
E. 腹中刺痛，固定不移

正确答案：A。腹痛急暴，得温痛减

解析：寒邪内阻于腹部，中阳被遏，脉络痹阻，故可见腹痛急暴，得温痛减（A对），遇冷更甚，口淡不渴，小便清利，大便自可或溏薄，舌苔白腻，脉沉紧，故治法宜温中散寒，理气止痛，宜选良附丸合正气天香散加减。腹痛绵绵，时痛时止（B错），是中虚脏寒腹痛的主要特点。腹痛拒按，烦渴引饮（C错），是湿热壅滞腹痛的主要特点。腹部胀痛，攻窜不定（D错），是肝郁气滞腹痛的主要特点。腹中刺痛，固定不移（E错），是瘀血内停腹痛的特点。